男，35岁。左上腹被拖拉机撞伤后钝痛1天，突发左上腹剧痛3小时。查体：P140次/分，BP60/45mmHg，面色苍白，四肢厥冷，上腹部中度压痛，肌紧张，腹部叩诊移动性浊音（+）。腹腔穿刺抽出不凝固血液。最可能的诊断是
A. 小肠破裂
B. 肝破裂
C. 结肠破裂
D. 胃破裂
E. 脾破裂

正确答案：E。脾破裂

解析：青年男性病人，左上腹外伤后腹痛（提示脾脏损伤），P140次/分（正常为60～100次/分），BP60/45mmHg（正常为90～139/60～89mmHg），面色苍白，四肢厥冷（提示休克），上腹中度压痛，肌紧张（腹膜刺激症状较轻，可排除空腔脏器损伤），腹部叩诊移动性浊音（+），腹腔穿刺抽出不凝固血液（提示腹腔实质性脏器损伤），结合患者病史、临床表现和相关检查，最可能的诊断为脾破裂（E对）。小肠破裂（A错）及胃破裂（D错）后，由于消化液可流入腹腔，早期即可引起明显的腹膜刺激征，但出血量一般不大，较少出现失血的症状。肝破裂（B错）多由于右上腹外伤所致，破裂发生后大量血液及胆汁进入腹腔，早期即可引起低血压及明显的腹膜刺激征。由于结肠内容物液体成分少而细菌含量多，因此结肠破裂（C错）后，腹膜刺激征出现晚且较重，一般不出现移动性浊音。